一对年轻夫妇计划出国旅游，出发前，准备选购以下治疗腹泻的药物备用，包括蒙脱石、口服补液盐、双歧杆菌三联活菌、洛哌丁胺，小檗碱。药店同时销售口服补液盐Ⅱ和口服补液盐Ⅲ，关于口服补液盐分类和临床应用的说法，错误的是
A. 口服补液盐Ⅲ是等渗性口服补液盐
B. 口服补液盐是复方制剂，Ⅱ、Ⅲ代表不同的配方
C. 腹泻导致重度脱水时首选静脉补液，情况稳定后可更换为口服补液治疗
D. 口服补液盐使用方便、价格低廉，发生腹泻时如能口服，应尽早使用
E. 为保证疗效，应严格按照说明书规定的水量稀释。

正确答案：A。口服补液盐Ⅲ是等渗性口服补液盐

解析：本题考查口服补液盐分类和临床应用。口服补液盐是复方制剂，Ⅱ、Ⅲ代表不同的配方，其中口服补液盐Ⅲ是低渗性口服补液盐（A错，为本题正确答案），钠和葡萄糖含量有所减少，是WHO推荐的低渗方案。